环丙沙星口服利用度约为
A. 0.5
B. 0.6
C. 0.7
D. 0.8
E. 0.9

正确答案：C。0.7

解析：本题考查环丙沙星的口服利用度。环丙沙星口服利用度约为70%（C对ABDE错）；诺氟沙星是第一个用于临床的氟喹诺酮类药物，口服生物利用度偏低（35%～45%）；氧氟沙星口服生物利用度高达95%；左氧氟沙星是消旋氧氟沙星的左旋体，口服生物利用度接近100%；洛美沙星口服生物利用度接近98%；氟罗沙星口服生物利用度接近100%；莫西沙星口服生物利用度约90%；加替沙星口服生物利用度为90%～96%；加雷沙星口服生物利用度约92%。